下列关于原穴的叙述，错误的是
A. 脉之气经过和留止部位的腧穴
B. 阴经的原穴多分布在掌指关节之前
C. 阳经的原穴多分布在腕踝关节之前
D. 可以治疗各自所属脏腑病变
E. 阴经的原穴就是五输穴中的输穴

正确答案：A。脉之气经过和留止部位的腧穴

解析：原穴是脏腑原气输注、经过和留止于十二经脉四肢部的的穴（A错，为本题正确答案）。可以治疗各自所属脏腑病变（D对），十二原穴多分布于腕踝关节附近（BC对）。阴经上的原穴与五输穴中的输穴同穴名、同部位，实为一穴，即所谓“阴经以输为原”（E对），阳经上的原穴位于五输穴中的输穴之后，即另置一原。